慢性肺心病患者，咳喘无力，气短难续，咳痰不爽，面色晦暗，心慌，唇甲发紫，神疲乏力，舌淡暗，脉沉细涩无力。治疗应首选
A. 越婢加半夏汤
B. 生脉散合血府逐瘀汤
C. 真武汤
D. 苏子降气汤
E. 补肺汤

正确答案：B。生脉散合血府逐瘀汤

解析：慢性肺心病，咳喘无力，气短难续，神疲乏力，为气虚之证的表现；咳痰不爽，面色晦暗，心慌，唇甲发紫，舌淡暗，脉沉细涩无力，为瘀血所致；辩证为气虚血瘀证，治宜益气活血，止咳化痰，生脉散合血府逐瘀汤对证（B对）。越婢加半夏汤清热化痰，降逆平喘，为慢性肺心病急性加重期痰热郁肺证的代表方（A错）。真武汤温肾健脾，与五苓散相合，可用于慢性肺心病急性加重期阳虚水泛证（C错）。苏子降气汤健脾益肺，化痰降气，是慢性肺心病急性加重期痰浊壅肺证的代表方（D错）。补肺汤补肺纳肾，降气平喘，适用于肺肾气虚证（E错）。